高温作业工人的胃肠道疾病应归类于
A. 职业病
B. 法定职业病
C. 职业性多发病
D. 职业性疾患
E. 职业特征

正确答案：C。职业性多发病